上颌侧切牙牙冠缺损1/3的患者，在修复初诊时不需问诊的内容是
A. 就诊的主要原因
B. 下颌运动是否正常
C. 缺损的原因
D. 已接受过的检查和治疗
E. 缺损时间的长短

正确答案：B。下颌运动是否正常

解析：本题考查临床接诊。上颌侧切牙牙冠缺损1/3的患者，在修复初诊时不需问诊的内容是下颌运动是否正常（B错，为本题的正确答案）。颞下颌关节疾病应检查下颌运动是否正常。牙体缺损患者修复前，医生需要了解患者的主诉和病史，即患者就诊的主要原因（A对）和要求解决的主要问题；了解患牙缺损的原因（C对），是否接受过检查和治疗，何种检查和治疗（D对），以及牙体缺损的时间（E对）等。